温里药的适应病证有
A. 肾阳虚
B. 肾阴虚
C. 中焦虚寒
D. 心肾阳衰
E. 中气下陷

正确答案：A、C、D。肾阳虚；中焦虚寒；心肾阳衰

解析：本题考查的是温里药的主要适应证。温里药的适应病证有肾阳虚（A对）、中焦虚寒（C对）与心肾阳衰（D对）。凡药性温热，以温里散寒为主要功效的药物，称为温里药。本类药主要适用于里寒证，包括中焦寒证、心肾阳衰之亡阳证、肾阳虚证、寒滞肝脉之疝痛、风寒湿痹、经寒痛经等。兼治寒饮咳喘、虫积腹痛等。肾阴虚（B错）为补阴药的主要适应证。补阴药属于补虚药。补虚药，习称补益药或补养药，是指凡能补充人体物质亏损、增强人体功能活动，以提高抗病能力、消除虚弱证候为主要功效的药物。本类药主要适用于各种虚证，而虚证有气虚、阳虚、血虚、阴虚之别。据此，其主治病证为：脾气虚之食少便溏、神疲乏力、脱肛，以及肺气虚之少言懒语、久咳虚喘、易出虚汗等气虚证；肾阳不足之畏寒肢冷、阳痿遗精、宫冷不孕、夜尿频多，以及脾肾阳虚之泄泻、肺肾两虚之喘嗽等阳虚证；心血虚或肝血不足所致的面色萎黄、唇甲苍白、头晕眼花、心慌心悸，以及妇女月经不调等血虚证；肺阴虚之干咳少痰、咽干喉燥，胃阴虚之口干舌燥、胃中嘈杂、大便秘结、舌红少苔，心阴虚之心烦不眠，以及肝肾阴虚之腰膝酸痛、遗精滑精、手足心热、潮热盗汗、眼目干涩等阴虚证。黄芪：【主治病证】（1）脾胃气虚，脾肺气虚，中气下陷（E错），气不摄血，气虚发热。（2）自汗，盗汗。（3）气血不足所致的疮痈不溃或溃久不敛。（4）气虚水肿、小便不利。（5）气血双亏，血虚萎黄，血痹肢麻，半身不遂，消渴。